水果中有机酸的作用不包括
A. 刺激消化液分泌
B. 促进钙的吸收
C. 保护维生素C的稳定性
D. 增强感官作用
E. 抑制膳食纤维作用

正确答案：E。抑制膳食纤维作用